患牙伸长而出现咬合障碍。X线片示牙根尖与牙槽窝的间隙明显增宽，属于牙脱位的哪一类型
A. 脱出性脱位
B. 嵌入性脱位
C. 牙齿完全脱位
D. 牙髓坏死
E. 牙根外吸收

正确答案：A。脱出性脱位

解析：脱出性脱位和侧向性脱位：因患牙伸长而出现咬合障碍。X线片示牙根尖与牙槽窝的间隙明显增宽。掌握“牙脱位”知识点。